微循环的营养通路是
A. 微动脉→动静脉吻合支→真毛细血管→微静脉
B. 微动脉→后微动脉→直通毛细血管→真毛细血管→微静脉
C. 微动脉→动静脉吻合支→微静脉
D. 微动脉→后微动脉→真毛细血管→微静脉
E. 微动→后微动动脉→直通毛细血管→微静脉

正确答案：D。微动脉→后微动脉→真毛细血管→微静脉

解析：微循环是指微动脉和微静脉之间的微血管内的血液循环，是血液和组织进行物质交换的基本结构和功能单位。微动脉→后微动脉→真毛细血管→微静脉（D对ABCE错）是微循环的营养通路。